切面有细密、银白色、富弹性的橡胶丝相连，气微，味稍苦的饮片是
A. 肉桂
B. 杜仲
C. 白鲜皮
D. 秦皮
E. 厚朴

正确答案：B。杜仲

解析：本题考查的是杜仲饮片的性状鉴别。切面有细密、银白色、富弹性的橡胶丝相连，气微，味稍苦的饮片是杜仲（B对）。杜仲：【性状鉴别】饮片呈小方块或丝状。外表面浅棕色或灰褐色，有明显的皱纹。内表面暗紫色，光滑。断面有细密、银白色、富弹性的橡胶丝相连。气微，味稍苦。肉桂（A错）：【性状鉴别】饮片呈槽状或卷筒状。外表面灰棕色，稍粗糙，有不规则的细皱纹及横向突起的皮孔，有的可见灰白色的斑纹；内表面红棕色，较平坦，有细纵纹，划之显油痕。质硬而脆，易折断，断面不平坦，外层棕色而较粗糙，内层红棕色而油润，两层中间有1条黄棕色的线纹。气香浓烈，味甜、辣。白鲜皮（C错）：【性状鉴别】饮片呈不规则的厚片，外表面灰白色或淡灰黄色，具细纵皱纹及细根痕，常有突起的颗粒状小点；内表面类白色，有细纵纹。切面类白色，略呈层片状。有羊膻气，味微苦。秦皮（D错）：【性状鉴别】饮片呈长短不一的丝条状。外表面灰白色、灰棕色或黑棕色。内表面黄白色或棕色，平滑。切面纤维性。质硬。气微，味苦。厚朴（E错）：【性状鉴别】饮片呈弯曲的丝条状或单、双卷筒状。外表面灰褐色，有时可见椭圆形皮孔或纵皱纹。内表面紫棕色或深紫褐色，较平滑，具细密纵纹，划之显油痕。切面颗粒性，有油性，有的可见小亮星。气香，味辛辣、微苦。